患者，男性，58岁，舌部出现白色病损3年，加重半年。查：舌背两侧各有一块约1～1.2cm白色斑块，边缘不齐，双颊白色斑块存在。临床诊断与下列哪种疾病鉴别
A. 口腔扁平苔藓
B. 白色念珠菌病
C. 盘状红斑狼疮
D. 单纯疱疹
E. 以上均不是

正确答案：A。口腔扁平苔藓

解析：本题考查白斑的诊断和鉴别诊断。患者，舌背两侧各有一块约1～1.2cm白色斑块，边缘不齐，双颊白色斑块存在。综合考虑应诊断为白斑。临床诊断与口腔扁平苔藓（A对）鉴别。斑块型扁平苔藓与口腔白斑病有时难以鉴别，特别是舌背上的病损，有时需要依靠组织病理检查来确诊。白色念珠菌病（B错）其通常表现为口腔黏膜出现散在成簇，或者孤立存在的绒毛状白色丘斑或者丘疹。盘状红斑狼疮（C错）主要表现为呈持久性盘状红色斑片，多为圆形、类圆形或不规则形，大小有几毫米，甚至10毫米以上，边界清楚。皮疹表面有毛细血管扩张和灰褐色黏着性鳞屑覆盖，鳞屑底面有角栓突起，剥除鳞屑可见扩张的毛囊口。单纯疱疹（D错）表现为局性簇集性小水疱，病毒长期潜伏和反复发作为其临床特征。